肺动脉高压早期的X线表现是
A. 双肺纹理增多
B. 双肺透亮度增加
C. 右下肺动脉主干增宽
D. 右心房肥大
E. 右心室肥厚、扩张

正确答案：C。右下肺动脉主干增宽

解析：肺动脉高压指肺动脉压力升高超过一定界值的一种血流动力学和病理生理状态，可导致右心衰竭，可以是一种独立的疾病，也可以是并发症，还可以是综合征。肺动脉高压的X线表现：①心脏改变：右心房、右心室扩大第十版药理学（多为肺动脉高压引起右心室肥厚后的表现，不是肺动脉高压的早期表现），肺动脉段“圆锥部”膨突，右前斜位胸片圆锥高度多7mn，主动脉结缩小。②右下肺动脉干扩张第十版药理学（早期的表现）（C对），>15mm为异常，其扩张程度与肺动脉高压相关，右下肺动脉横径与气管横径比值>1.07。③肺门阴影增宽。④心胸比率增大：正常心胸比率<0.5，肺动脉高压时心胸比>0.5。⑤中心肺动脉扩张：外周分支细小，两者形成鲜明对比。双肺纹理增多（A错）为肺炎的X线表现。双肺透亮度增加（B错）为慢性阻塞性肺气肿的X线表现。右心房肥大（D错）、右心室肥厚、扩张（E错）均为肺动脉高压晚期的表现。